预后最好的乳腺癌病理类型是
A. 硬癌
B. 单纯癌
C. 导管内癌
D. 黏液腺癌
E. 髓样癌

正确答案：C。导管内癌

解析：乳腺癌是女性最常见的恶性肿瘤之一，其病理类型主要分为三类，即非浸润性癌、浸润性特殊癌及浸润性非特殊癌，其中非浸润性癌是预后最好的病理类型。导管内癌（C对）指癌细胞未突破导管壁基底膜，属于非浸润性癌，此型属早期，预后最好。硬癌（A错）、单纯癌（B错）及髓样癌（无大量淋巴细胞浸润）属于浸润性非特殊癌，此型是乳腺癌中最常见的类型，一般分化低，预后最差。黏液腺癌（D错）、髓样癌（E错）（伴大量淋巴细胞浸润）等属于浸润性特殊癌，预后较非浸润性癌差。